女，21岁。一天来寒战高热咳嗽伴右胸痛，咳砖红色胶冻痰，量多。胸片右肺呈多发性蜂窝状阴影。正确选用抗生素为
A. 青霉素
B. 青霉素+链霉素
C. 青霉素+庆大霉素
D. 庆大霉素+头孢曲松钠
E. 青霉素+头孢曲松钠

正确答案：D。庆大霉素+头孢曲松钠

解析：患者为青年女性，寒战高热咳嗽伴右胸痛，咳砖红色胶冻痰（为克雷伯杆菌肺炎特征性的痰液），胸片右肺呈多发性蜂窝状阴影，根据其临床表现和辅助检查，该患者考虑诊断为肺炎克雷伯杆菌肺炎。肺炎克雷伯杆菌肺炎要用针对革兰阴性杆菌的抗菌药物，剂量要充分，疗程要长，常两种药物联合用药，如第二、第三代头孢菌素联合氨基糖苷类抗生素。头孢曲松钠为第三代头孢菌素，庆大霉素为氨基糖苷类抗生素，所以该患者正确的选用抗生素为庆大霉素＋头孢曲松钠（D对ABCE错）。